右心室肥大的心电图可表现为
A. RV₁＞1.0mVRV₁+SV₅＞1.2mV
B. V₃V₄导联呈RS型，R/S接近于1
C. V₅V₆导联以R波为主，R/S＞1，RV₅＜2.5mV
D. V₁至V₅，R波逐渐增大，而S波逐渐变小
E. RV₅＞2.5mV，V₁或RV₅+SV₁＞3.5～4.0mV

正确答案：A。RV₁＞1.0mVRV₁+SV₅＞1.2mV

解析：右心室肥大的心电图特点是：①QRS波群电压增高：Rv₁＞1.0 mV，Rv₁十Sv₅＞1.05mV（重症>1.2mV，RaVR＞0.5mV（A对）。②QRS波群形态改变：V₁导联的R波电压增高，呈RS、R型，R/S＞1，重度右心室肥大时V₁可呈qR型（除外心肌梗死），V₅导联S波加深，R/S＜1。aVR导联以R波为主，R/Q＞1或R/S＞1（BCD错）。③心电轴右偏≥+90°，重者＞+110°。④继发性ST-T改变：V₁、V₂等右胸导联ST段下移＞0.05mV，T波低平、双向或倒置。⑤V₁导联R峰时间＞0.04s，但QRS波群时间并不延长。RV₅＞2.5mV，V₁或RV₅+SV₁＞3.5～4.0mV为左心室肥大特点（E错）。